下列属于脂溶性维生素的是
A. 叶酸
B. 维生素B₂
C. 维生素B₆
D. 维生素C
E. 维生素D

正确答案：E。维生素D

解析：本题考查脂溶性维生素。常见的脂溶性维生素有：维生素A、维生素D（E对）、维生素E、维生素K。常见的水溶性维生素有：B族维生素（ABC错）、维生素C（D错）等。